对下颌下腺的扪诊检查应选用
A. 一般以示、中、无名三指平触
B. 双手合诊法
C. 双指双合诊法
D. 双指提拉式扪诊
E. 单指扪诊

正确答案：B。双手合诊法

解析：下颌下腺及舌下腺的触诊则常用双手合诊法检查。涎腺导管的触诊除注意有无结石存在外，还应注意导管的粗细和质地。掌握“口外一般检查及辅助检查”知识点。